按渗出物的最主要成分分类，大叶性肺炎属于
A. 浆液性炎
B. 化脓性炎
C. 出血性炎
D. 纤维素性炎
E. 卡他性炎

正确答案：D。纤维素性炎

解析：浆液性炎以浆液渗出为其特征，浆液性炎常发生于黏膜、浆膜、滑膜、皮肤和疏松结缔组织等。浆膜的浆液性炎如渗出性结核性胸膜炎，可引起胸腔积液（A错）。黏膜的浆液性炎又称浆液性卡他性炎，卡他是指渗出物沿黏膜表面顺势下流的意思，如感冒初期，鼻黏膜排出大量浆液性分泌物（E错）。化脓性炎以中性粒细胞渗出并伴有不同程度的组织坏死和脓液形成为其特点（B错）。出血性炎是指炎症病灶的血管损伤严重，渗出物中含有大量红细胞。常见于流行性出血热、钩端螺旋体病和鼠疫等（C错）。